对医疗机构的执业要求规定，医疗机构必须将以下项目悬挂于明显处，除了
A. 医疗机构执业许可证
B. 诊疗科目
C. 诊疗医生
D. 收费标准
E. 诊疗时间

正确答案：C。诊疗医生

解析：医疗机构必须将《医疗机构执业许可证》、诊疗科目、诊疗时间和收费标准悬挂于明显处，定点亮证行医，不得开展核准登记科目之外的诊疗活动。掌握“医疗机构概述及机构执业”知识点。